女，26岁。产前检查发现子宫肌瘤直径2cm。足月顺产后，阴道流血淋漓2月余。前日妇科检查子宫如孕10周，均匀增大，血hCG阳性。为明确诊断应行的检查是
A. B型超声检查
B. 宫腔镜检
C. 盆腔CT
D. 盆腔磁共振成像
E. 腹部平片

正确答案：A。B型超声检查

解析：该患者产前检查发现子宫肌瘤直径2cm。足月顺产后，阴道流血淋漓2月余（妊娠滋养细胞肿瘤常见于葡萄胎排空后或流产、足月分娩、异位妊娠后出现阴道流血），妇科检查子宫如孕10周，均匀增大（妊娠滋养细胞肿瘤常于产后子宫未恢复到正常大小，而表现为子宫增大），血hCG阳性（妊娠滋养细胞肿瘤常在足月产后超过4周血hCG仍为阳性，或一度下降后又上升）。结合患者的临床表现，可诊断为妊娠滋养细胞肿瘤。对于妊娠滋养细胞肿瘤诊断子宫原发病灶最常用的检查为B型超声检查（A对）。宫腔镜检（B错）虽然也可辅助诊断，但不是必需的（P340）。盆腔CT（C错）和盆腔磁共振成像（D错）不是常规检查，主要用于转移病灶的诊断（P340）。腹部平片（E错）对于妊娠滋养细胞肿瘤的诊断价值不大。